患者，女，28岁，妊娠6周，因燥热、心慌、消瘦1月余就诊。查体：心率132次/分，甲状腺功能检查示：FT₃、FT₄升高，TSH降低。适宜的治疗方案是
A. ¹³¹I放射治疗，酒石酸美托洛尔片25mg bid
B. 丙硫氧嘧啶片100mg tid，盐酸普萘洛尔片10mg tid
C. 甲巯咪唑片20mg qd，盐酸普萘洛尔片20mg tid
D. 甲巯咪唑20mg qd，酒石酸美托洛尔片25mg bid
E. 甲巯咪唑片20mg qd，丙硫氧嘧啶片100mg tid

正确答案：B。丙硫氧嘧啶片100mg tid，盐酸普萘洛尔片10mg tid

解析：本题考查妊娠甲亢的药物治疗。该患者属于妊娠期甲亢且心率偏高，妊娠期的甲亢患者首选丙硫氧嘧啶（300～450mg/d，分3次口服，治疗）；β受体阻断剂可降低患者的心率且能阻断甲状腺激素的外周效应，阻断外周T₄向T₃的转化，可选用普萘洛尔10～20mg，每6～8小时1次（B对）。